在代谢过程中，主要代谢产物为C3-羟基化合物的是
A. 苯巴比妥
B. 苯妥英钠
C. 阿普唑仑
D. 卡马西平
E. 地西泮

正确答案：E。地西泮

解析：本题考查苯二氮䓬类药物地西泮。在代谢过程中，主要代谢产物为C3-羟基化合物的是地西泮（E对）。地西泮体内代谢主要在肝脏进行，其代谢途径为N-1去甲基、C-3羟基化，形成的羟基代谢产物与葡萄糖醛酸结合排出体外，C-3羟基化代谢物有抑制中枢生物活性的作用。巴比妥类药物主要在肝脏进行代谢，包括5位取代基的氧化，水解开环等。苯巴比妥（A错）部分在肝脏代谢为羟基苯巴比妥，再和葡萄糖醛酸结合后排出体外，这种代谢约占原药的11%～25%，其余大多以原药排出体外。苯妥英钠（B错）主要在肝脏被CYP2C9酶代谢成5-（4-羟基苯基）-5-苯基乙酰脲。阿普唑仑（C错）大部分经肝脏代谢，代谢产物4-羟基阿普唑仑，也有一定药理活性，代谢产物经肾排泄。卡马西平（D错）的经肝代谢生成的10，11-环氧卡马西平具有与母药相似的抗癫痫活性，经肾排泄。